HDL是指
A. 运送内源性TG
B. 运送内源性Ch
C. 运送外源性TG
D. 蛋白质含量最高
E. 与冠状动脉粥样硬化的发生率呈负相关

正确答案：D。蛋白质含量最高

解析：高密度脂蛋白（HDL）是血液中密度最高，颗粒最小的一种脂蛋白，是血脂代谢的基础物质，专门在体内结合多余血脂，转运体外，清除血液垃圾；且由于体积小，能穿透动脉内膜将沉积在里面的胆固醇清除掉并携带出血管壁，修复血管内皮破损细胞，恢复血管弹性，具有清除血管内多余血脂，清除血垢，清洁血管的作用。掌握“甘油磷脂、胆固醇和血脂蛋白代谢”知识点。